下列细菌中哪种最常引起医院感染
A. 伤寒沙门菌
B. 结核分枝杆菌
C. 耐药性金黄色葡萄球菌
D. 乙型溶血性链球菌
E. 变形杆菌

正确答案：C。耐药性金黄色葡萄球菌